男，20岁。踢球时突然一过性意识丧失，后自行恢复。发作时无四肢抽搐和口吐白沫。超声心动图示舒张期室间隔与后壁厚度之比为1.7，SAM现象阳性。该患者意识丧失最可能的原因是
A. 血管迷走性晕厥
B. 体位性低血压
C. 肥厚型梗阻性心肌病
D. 限制型心肌病
E. 癔症

正确答案：C。肥厚型梗阻性心肌病

解析：青少年男性【肥厚性心肌病（HCM）好发人群】，踢球时突然一过性意识丧失，后自行恢复（HCM是青少年运动猝死的主要原因）。发作时无四肢抽搐和口吐白沫（排除癫痫）。超声心动图示舒张期室间隔与后壁厚度之比为1.7（≥1.3，提示流出道梗阻），SAM现象阳性。据患者年龄、临床表现及影像学检查，考虑诊断为肥厚性梗阻型心肌病（C对）。SAM现象阳性：即左心室收缩时快速血流通过狭窄的流出道产生负压，引起二尖瓣前叶前向运动，提示左室流出道梗阻。限制型心肌病（D错）是以心室壁僵硬度增加、舒张功能降低、充盈受限而产生临床右心衰症状为特征的一类心肌病。主要表现为活动耐量下降、乏力、 呼吸困难（P269）。